男，35岁。左下腹外伤后24小时。入院时有弥漫性腹膜炎，行剖腹探查术。术中见腹腔内有黄色脓液及粪便，降结肠下段有一0.5cm穿孔，有粪便溢出。最合适的术式是
A. 穿孔处修补，横结肠造口
B. 单纯结肠穿孔修补术
C. 降结肠穿孔处切除，段端吻合术
D. 左半结肠切除术
E. 单纯腹腔引流术

正确答案：A。穿孔处修补，横结肠造口

解析：青年男性患者，腹部外伤后手术探查，术中见降结肠下段一较小穿孔，有粪便溢出，腹腔内有黄色脓液及粪便，提示腹腔污染严重，不宜一期修补或切除吻合，最合适的术式为穿孔处修补，横结肠造口（A对），待病人情况好转后，再行关闭瘘口。仅行单纯结肠穿孔修补术（B错）或降结肠穿孔处切除，端端吻合术（C错）或左半结肠切除术（D错），而不行造瘘术，肠内容物仍可进入损伤部位的结肠，将影响伤口愈合，甚至造成严重的腹腔感染，故不是该患者最佳的手术方式。单纯腹腔引流术（E错）可减轻腹腔感染症状，但不能修补结肠穿孔，最终形成肠瘘。